最早提出烧灼法断脐预防脐风的儿科专著是
A. 《小儿药证直诀》
B. 《小儿卫生总微论方》
C. 《幼科发挥》
D. 《保婴撮要》
E. 《幼幼集成》

正确答案：B。《小儿卫生总微论方》

解析：该题考查儿科的发展史。钱乙的《小儿药证直诀》将小儿的生理病理特点概括为“脏腑柔弱，易虚易实、易寒易热”（A错）。《小儿卫生总微论方》提出了烧灼法断脐预防脐风的方法（B对）。万全的《幼科发挥》对儿科的疾病有自己的见解（C错）。薛铠、薛己的《保婴撮要》除论述小儿内科疾病外，还对中医小儿外科学的形成作出重大贡献（D错）。陈复正的《幼幼集成》对指纹诊法颇有见地（E错）。